使用过量而致出血可用硫酸鱼精蛋白对抗的药物是
A. 华法林
B. 肝素
C. 链激酶
D. 维生素B₁₂
E. 双嘧达莫

正确答案：B。肝素

解析：本题考查肝素。肝素（B对）使用过量所致的出血应用鱼精蛋白对抗治疗。鱼精蛋白带有正电荷，可与肝素结合形成稳定的复合物，使肝素失去抗凝血作用。维生素K可用于华法林（A错）过量所致的出血。链激酶（C错）引起的出血可用氨基己酸等抗纤溶药注射止血。维生素B₁₂（D错）用于巨幼红细胞性贫血、神经炎、口炎性腹泻等一系列疾病。双嘧达莫（E错）主要用于缺血性心脏病、血栓栓塞性疾病、心肌缺血的诊断实验。